出现典型的“两慢一高”，即血压升高、脉搏徐缓有力、呼吸慢而深时，表明可能存在
A. 脑震荡
B. 脑挫裂伤
C. 急性颅内血肿
D. 颅骨骨折
E. 脑脊液漏口腔颌面部邻近颅脑，颌面伤常伴发颅脑损伤

正确答案：C。急性颅内血肿

解析：瞳孔的变化常能反映颅内损伤的程度，如一侧瞳孔变大，并伴有意识障碍，常提示同侧颅内有血肿或水肿的可能。如出现典型的“两慢一高”，即血压升高、脉搏徐缓有力、呼吸慢而深时，表明存在急性颅内血肿的可能。掌握“口腔颌面部创伤急救”知识点。